女婴，10个月。腹泻3天，加重2天。暗红色水样便每日10余次，量多，腥臭，伴高热、呕吐、严重少尿或无尿。查体：前卤眼窝凹陷，皮肤弹性差，粘膜非常干燥，心音较低钝，腹胀，肝脾不大。实验室检查：粪镜检有大量脓血细胞，血钠135mmol/L，血钾3.5mmol/L。该患儿腹泻脱水的程度与性质应是
A. 重度等渗性
B. 中度等渗性
C. 中度低渗性
D. 中度高渗性
E. 重度低渗性

正确答案：A。重度等渗性

解析：本例患儿腹泻、暗红色水样便、量多、腥臭、高热、呕吐、严重少尿或无尿，前囟眼窝凹陷，皮肤弹性差，粘膜非常干燥，心音较低钝，腹胀，最可能的诊断是大肠埃希菌肠炎，腹泻易发生脱水，血清电解质和血浆渗透压常相互关联，因为渗透压很大程度上取决于血清阳离子，即钠离子，血钠135mmol/L（等渗性脱水时血清钠在130~150mmol/L），符合等渗性脱水，根据前卤眼窝凹陷，皮肤弹性差，粘膜非常干燥，心音较低钝等体征，可确定该患儿腹泻脱水的程度与性质应是重度等渗性（A对）。